损害胎儿生长发育的因素属于
A. 生物性致病因素
B. 先天性致病因索
C. 理化性致病因素
D. 免疫性致病因素
E. 遗传性致病因素

正确答案：B。先天性致病因索

解析：先天性致病因素（B对）指那些损害胎儿发育的因素。